石瘿痰瘀内结证，内治应首选的方剂是
A. 四海舒郁丸
B. 柴胡清肝汤
C. 海藻玉壶汤合桃红四物汤
D. 养阴清肺汤
E. 通窍活血汤合桃红四物汤

正确答案：C。海藻玉壶汤合桃红四物汤

解析：石瘿其痰瘀内结证当解郁化痰，活血消坚，方用海藻玉壶汤合桃红四物汤加减（C对）。四海舒郁丸功能疏肝解郁，化痰软坚，用于气瘿之肝郁气滞证（A错）。柴胡清肝汤具有养血清火，疏肝散结之功，用于瘿痈之气滞痰凝证（B错）。养阴清肺汤与通窍活血汤合用，治疗石瘿之瘀热伤阴（D错）。通窍活血汤合桃红四物汤两者均无解郁化痰之功，不能治疗石瘿之痰瘀内结证（E错）。